可用于治疗高血压病的药物有
A. 奎尼丁
B. 哌唑嗪
C. 尼卡地平
D. 氨力农
E. 呱乙啶

正确答案：B、C、E。哌唑嗪；尼卡地平；呱乙啶

解析：本题考查抗高血压药。哌唑嗪（B对）、尼卡地平（C对）、胍乙啶（E对）可用于治疗高血压病。哌唑嗪为选择性突触后α₁受体阻滞药，能同时扩张阻力血管和容量血管，适合老年高血压患者合并前列腺增生者。尼卡地平为通过抑制Ca²⁺流入血管平滑肌细胞而发挥血管扩张作用，而且能抑制磷酸二酯酶，使脑，冠状动脉及肾血流量增加，起到降压作用。胍乙啶为抗去甲肾上腺素能神经末梢药，适用于舒张压较高的重度高血压患者，亦适用于轻、中度高血压。奎尼丁（A错）为钠离子通道抑制性抗心律失常药。氨力农（D错）为磷酸二脂酶抑制剂类非苷类正性肌力药，用于心力衰竭治疗。